初产妇，25岁。妊娠40周，临产10小时宫口开大6cm，已破水，头先露，S+1，5小时后查胎心142次/分，宫口仍为6cm，最可能的诊断是
A. 活跃期停滞
B. 活跃期延长
C. 正常产程
D. 潜伏期延长
E. 第二产程延长

正确答案：A。活跃期停滞

解析：初产妇，临产10小时宫口开大6cm（进入第一产程活跃期），头先露，S+1，5小时（≥4小时）后宫口仍为6cm，最可能的诊断是活跃期停滞（A对）。正常分娩分为3个阶段：第一产程称宫颈扩张期，指从规律宫缩开始到宫颈口开全（10cm），分潜伏期和活跃期：潜伏期指从临产规律宫缩开始至活跃期起点(4～6cm） ，初产妇＞20 小时、经产妇＞14小时称为潜伏期延长（D错）；活跃期异常包括活跃期延长（B错）和活跃期停滞（A对）：前者为从活跃期起点至宫颈口开全，该阶段宫颈口扩张速度＜0.5cm/h即可确诊；后者为当破膜且宫颈口扩张≥6cm后，若宫缩正常，宫颈口停止扩张≥4小时；若宫缩欠佳，宫颈口停止扩张≥6小时确诊。第二产程称胎儿娩出期，指从宫口开全至胎儿娩出，该阶段若初产妇＞3小时，经产妇＞2小时而生产无进展，则为第二产程延长（E错）。第三产程为胎盘娩出期，即从胎儿娩出到胎盘娩出。